喉炎时易发生水肿
A. 喉口
B. 喉前庭
C. 喉中间腔
D. 喉室
E. 声门下腔

正确答案：E。声门下腔

解析：声门下腔喉炎时易发生喉水肿（E对）。